男，64岁，2周前无明显诱因出现咳嗽，咳黄白痰，带血丝，经抗生素治疗效果不佳。体检：体温37.8℃，血压正常，右上肺呼吸音稍弱伴少许湿啰音。血象WBC12×10⁹/L，N0.83。最可能的诊断是
A. 肺炎链球菌肺炎
B. 急性肺脓肿
C. 包裹性胸腔积液
D. 肺结核
E. 肺癌合并肺部感染

正确答案：E。肺癌合并肺部感染

解析：患者为老年男性（肺癌的好发年龄），咳黄白痰带血丝，抗生素治疗效果不佳（抗生素对肺癌效果不佳），首先要考虑肺癌的可能性，患者还存在低热、肺部少许湿啰音，血象WBC12×10⁹/L（正常为4～10），N.0.83（正常为0.50～0.70）提示存在感染，根据其临床表现和辅助检查，考虑肺癌合并有肺部感染（E对）。肺炎链球菌肺炎（P46）（A错）、急性肺脓肿（P60）（B错）对抗生素治疗均有效。肺结核（P65）（D错）存在痰中带血，但主要的临床特点是结核毒血症状（午后潮热，倦怠乏力、盗汗、食欲减退和体重减轻），该患者不存在这些症状。包裹性胸腔积液（C错）常见于结核性胸膜炎诊断不及时或治疗不当，引起胸水吸收慢，胸膜肥厚粘连及纤维包裹而形成的，该患者无结核病史，故不考虑诊断为包裹性胸腔积液。